膻中被称为
A. 髓海
B. 血海
C. 气海
D. 水谷之海
E. 十二经脉之海

正确答案：C。气海

解析：本题考查的是膻中。膻中被称为气海（C对）。宗气：是积于胸中之气。宗气在胸中集聚之处，称作“气海”，又称“膻中”。宗气由肺吸入的清气和脾胃运化产生的水谷精气相互结合而生成。因此，肺的呼吸功能与脾胃的运化功能正常与否，直接影响着宗气的盛衰。宗气聚集于胸中，向上分布于肺与息道，向下贯注于心脉，布散全身。髓海（A错）指脑。中医认为，脑为髓聚之处，故称“脑为髓之海”。脑髓也依赖于肾精的充养。肾精充足，髓海满盈，则思维敏捷，耳聪目明，精神饱满。肾精亏虚则髓海不足，脑失所养，在小儿可见智力低下，甚则痴呆，在成人可见思维缓慢，记忆衰减，耳聋目花。血海（B错）与十二经脉之海（E错）指冲脉。冲脉的基本功能：（1）调节十二经气血，故称“十二经脉之海”。（2）冲为血海，有促进生殖之功能，并同妇女的月经有着密切的联系。水谷之海（D错）指胃。胃的生理功能：1.胃主受纳腐熟：饮食入口，经过食管，容纳于胃，故称胃为“太仓”“水谷之海”。经过胃的腐熟，即初步消化，形成食糜，而下传于小肠。水谷精微部分经脾之运化而营养全身，故称脾胃为“后天之本”。脾胃对饮食水谷的消化功能，又常概括称为“胃气”。由此，中医临床诊治疾病，十分重视“胃气”的盛衰。有胃气则平，少胃气则病，无胃气则死。故“人以胃气为本”，把“保胃气”作为重要的治疗原则。2.胃主通降，以降为和：胃为“水谷之海”，饮食物入胃后，经过胃的腐熟，必须下行而入小肠，以便进一步消化吸收。胃的通畅、下降，对于小肠、大肠之气的通降具有重要作用。